下列关于IgA肾病的描述，正确的是
A. 以血尿为主要表现的继发性肾小球疾病
B. 确诊有赖于肾活检病理检查
C. 病理类型主要为系膜毛细血管性肾小球肾炎
D. 本病发生于青壮年，临床表现单一
E. 预后佳，不会发生肾衰竭

正确答案：B。确诊有赖于肾活检病理检查

解析：IgA 肾病(是指肾小球系膜区以IgA 或IgA 沉积为主的肾小球疾病，是目前世界范围内最常见的原发性肾小球疾病（A错），好发于儿童和青少年，男性多见，多数患者起病前数小时或数日内有上呼吸道或消化道感染等前驱症状，主要表现为发作性的肉眼血尿或镜下血尿，肉眼血尿常为无痛性， 可伴少量蛋白尿。部分患者起病隐匿， 表现为无症状性血尿和（或）蛋白尿，部分患者表现为肾病综合征、严重高血压及肾功能损害，全身症状轻重不一，可表现为全身不适、乏力和肌肉疼痛等（D错）。确诊有赖于肾活检病理检查（B对），主要病理特点是肾小球系膜细胞增生和系膜外基质增多，肾小球系膜区单纯IgA或以IgA为主的免疫球蛋白沉积，呈块状或颗粒状分布；病变轻重不一，可表现为局灶或弥漫系膜细胞增生，部分患者肾活检时已发展至肾小球硬化（C错），本病预后个体差异很大，有些病人长期预后良好，但有些病人快速进展至肾衰竭（E错）。